女，15岁。双下肢水肿1个月。实验室检查：尿RBC25～30/HP，尿蛋白定量3.9g/d，肾功能正常，血Alb29g/L，抗核抗体（-），HBsAg阳性。肾脏病理提示膜性肾病。最可能的诊断是
A. 狼疮性肾炎
B. 原发性肾病综合症
C. 过敏性紫癜性肾炎
D. 乙肝病毒相关性肾炎
E. 急性肾小球肾炎

正确答案：D。乙肝病毒相关性肾炎

解析：患者青年女性，出现血尿（尿RBC25～30/HP）大量蛋白尿（尿蛋白定量3.9g/d，尿蛋白定量＞3.5g/d即为大量蛋白尿）、低蛋白血症（血Alb29g/L，血白蛋白＜30/L即为低白蛋白血症）以及水肿，提示为肾病综合征，病理类型是膜性肾病（乙型肝炎病毒相关性肾炎的常见病理类型），结合HBsAg 阳性，最可能是诊断是乙肝病毒相关性肾炎（D对）引发的继发性肾病综合征。抗核抗体（-），可排除狼疮性肾炎（A错）。原发性肾病综合症（B错）是在排除各种继发性肾病综合征可能的基础上才可确诊，患者HBsAg阳性，且病理类型是膜性肾病（非青少年原发性肾病综合征的常见类型），提示为继发性肾病综合征。过敏性紫癜性肾炎（C错）多有前驱感染（其病因可为细菌、病毒及寄生虫等感染）或过敏原接触史，病情严重，在皮肤紫癜的基础上，因肾小球毛细血管袢炎症反应而出现血尿、蛋白尿及管型尿，偶见水肿、高血压及肾衰竭等表现（P613）。肾损害多发生于紫癜出现后1周，亦可延迟出现。患者无前驱感染史及过敏原接触史，无紫癜症状，故可排除。急性肾小球肾炎（E错）通常于前驱感染后1-3周（平均10天左右）起病，常有血尿、蛋白尿、水肿、高血压，呈肾炎综合征表现，病理类型是毛细血管内增生性肾小球肾炎（P466）。